《药品经营许可证》应当载明
A. 企业名称
B. 法定代表人或企业负责人姓名
C. 质量负责人姓名
D. 经营方式
E. 经营范围

正确答案：A、B、C、D、E。企业名称；法定代表人或企业负责人姓名；质量负责人姓名；经营方式；经营范围

解析：本题考查的是药品经营许可证管理规定。《药品经营许可证》应当载明企业名称（A对）、法定代表人或企业负责人姓名（B对）、质量负责人姓名（C对）、经营方式（D对）、经营范围（E对）。药品经营许可证管理规定：药品经营许可证分为正本和副本，有效期为5年。药品经营许可证样式由国家药品监督管理局统一制定。药品经营许可证电子证书与纸质证书具有同等法律效力。禁止伪造、变造、出租、出借、买卖药品经营许可证。药品经营许可证应当载明许可证编号、企业名称、社会信用代码、注册地址、法定代表人、主要负责人、质量负责人、仓库地址、经营范围、经营方式、发证机关、发证日期、有效期限等内容。其中，企业名称、社会信用代码、法定代表人等项目应当与市场监督管理部门核发的营业执照中载明的相关内容一致。药品经营许可证登载事项发生变更的，由原发证机关在副本上记录变更的内容和时间，并按变更后的内容重新核发药品经营许可证正本，收回原药品经营许可证正本。新核发的药品经营许可证证号、有效期不变。